逆行性牙髓炎的患牙保留计划错误的是
A. 如果牙周袋能消除或变浅，病变能得到控制，则可先作牙髓治疗，同时开始牙周炎的一系列治疗
B. 如果多根牙只有一个牙根有深牙周袋引起的牙髓炎，且患牙不太松动，则可在根管治疗和牙周炎症控制后，将患根截除，保留患牙
C. 如牙周病变已十分严重，不易彻底控制炎症，则可直接拔牙止痛
D. 患牙过于松动，也不可拔牙，应完善治疗再做处理
E. 主要取决于该牙牙周病变的程度和牙周治疗的预后

正确答案：D。患牙过于松动，也不可拔牙，应完善治疗再做处理

解析：逆行性牙髓炎的患牙能否保留，主要取决于该牙牙周病变的程度和牙周治疗的预后。如果牙周袋能消除或变浅，病变能得到控制，则可先作牙髓治疗，同时开始牙周炎的一系列治疗。如果多根牙只有一个牙根有深牙周袋引起的牙髓炎，且患牙不太松动，则可在根管治疗和牙周炎症控制后，将患根截除，保留患牙。如牙周病变已十分严重，不易彻底控制炎症，或患牙过于松动，则可直接拔牙止痛。掌握“牙周-牙髓联合病变”知识点。